诊断张力性气胸最充分的依据是
A. 呼吸困难并伴有皮下气肿
B. 伤侧胸部叩诊呈高调鼓音
C. 伤侧呼吸音消失
D. X线见纵膈向健侧移位
E. 胸膜腔穿刺有高压气体

正确答案：E。胸膜腔穿刺有高压气体

解析：张力性气胸为气管、支气管或肺损伤处形成活瓣，气体只能单向经损伤处进入胸膜腔而不能呼出，随着每次吸气胸膜腔内气体逐渐积累增多，导致胸膜腔压力高于大气压，胸膜腔穿刺可抽出高压气体（E对）。呼吸困难和皮下气肿（A错）虽可见于张力性气胸，但特异性不及胸膜腔抽出高压气体。伤侧胸部叩诊呈高调鼓音（B错）、伤侧呼吸音消失（C错）、X线见纵隔向健侧移位（D错）均为气胸的一般表现，对张力性气胸的诊断没有特异性。